心包积液超声心动图显示
A. 左室扩大，流出道增宽，室间隔及左室后壁运动减弱
B. 室间隔非对称性肥厚，舒张期室间隔厚度与左室后壁之比≥1.3：1
C. 心前壁之前和心后壁之后有液性暗区
D. 瓣叶有赘生物及瓣叶穿孔
E. 舒张期二尖瓣前叶呈圆拱状，后叶活动度减弱，交界处融合，瓣叶增厚和瓣口面积减小

正确答案：C。心前壁之前和心后壁之后有液性暗区

解析：正常心包腔内可有20～30ml液体起润滑作用，超声心动图难以发现，若心前壁之前和心后壁之后有液性暗区（C对），则可确诊为心包积液。左室扩大，流出道增宽，室间隔及左室后壁运动减弱（A错）为扩张型心肌病（P263）的超声心动图表现。室间隔非对称性肥厚，舒张期室间隔厚度与左室后壁之比≥1.3：1为肥厚型心肌病（P266）（B错）的超声心动图表现。瓣叶有赘生物及瓣叶穿孔（D错）为感染性心内膜炎（P311）的超声心动图表现。舒张期二尖瓣前叶呈圆拱状，后叶活动度减弱，交界处融合，瓣叶增厚和瓣口面积减小（E错）为二尖瓣狭窄（P288）的典型超声心动图表现。